男，70岁。间断咳嗽30余年，加重伴意识障碍2天入院。查体：T38.0℃，P102次/分，R21次/分，BP120/80mmHg，烦躁不安，球结膜充血水肿，口唇发绀。桶状胸，双肺可闻及哮鸣音，双下肺少量湿性啰音。对诊断最有意义的检查是
A. 心电图
B. 脑电图
C. 痰细菌培养
D. 动脉血气分析
E. 胸部CT

正确答案：D。动脉血气分析

解析：患者为老年男性，间断咳嗽30余年，桶状胸（为慢阻肺典型的体征），双肺可闻及哮鸣音，双下肺少量湿啰音，考虑诊断为慢性阻塞性肺疾病（COPD）。加重伴意识障碍，烦躁不安，球结膜充血水肿，口唇发绀，出现缺氧和二氧化碳潴留的临床表现，考虑为COPD导致的肺性脑病，对诊断肺性脑病最有意义的检查是血气分析（D对）（可测定体内是否存在缺氧和二氧化碳潴留）。心电图（A错）主要是了解各种心律失常、心肌缺血/梗死、房室肥大或电解质紊乱等。脑电图（B错）用于癫痫等疾病的诊断。痰细菌培养（C错）常用于肺部感染病原体的确诊。胸部CT（E错）用于了解肺部肿块、积液和支气管扩张，也可见慢阻肺小气道病变的表现、肺气肿的表现以及并发症的表现，但是其主要临床意义在于排除其他具有相似症状的呼吸系统疾病（P23）。